药剂科人员的道德要求不包含以下哪一点
A. 廉洁奉公，忠于职守
B. 执行各项规定和规程
C. 如处方有误，可以由药剂科人员更改处方
D. 态度和蔼，认真负责
E. 正确地向患者交待服药的方法和剂量

正确答案：C。如处方有误，可以由药剂科人员更改处方